起病急，头痛重，伴有呕吐，意识障碍严重，有典型的神经系统局灶体征，应首先考虑的是
A. 短暂性脑缺血发作
B. 脑血栓
C. 脑栓塞
D. 脑出血
E. 蛛网膜下腔出血

正确答案：D。脑出血

解析：脑出血起病急，常有头痛，呕吐，打哈欠等颅内压增高症及不同程度的意识障碍，血压增高明显（D对）。短暂性脑缺血发作症见发作突然，迅速出现局限性神经功能或视网膜功能障碍，多与5分钟左右出现高峰，历时短暂，恢复快，不留后遗症（A错）。脑血栓常在安静或休息状态下发病，大多数患者意识清楚，或仅有轻度意识障碍（B错）。脑栓塞起病急骤，一般临床症状较重常有心脏病史，特别是心房纤颤，感染性心内膜炎，心肌梗死或其他易产生栓子的疾病时应考虑脑栓塞（C错）。蛛网膜下腔出血起病突然，可有用力，情绪激动等诱因，头痛剧烈，血压多正常，或可增高，脑膜刺激征常无局灶性体征（E错）。